下列各项对诊断伤寒最有意义的是
A. 稽留热
B. 血细菌培养阳性
C. 脾大
D. 肝大
E. 相对缓脉

正确答案：B。血细菌培养阳性

解析：血培养检出伤寒杆菌于伤寒病程第1～2周阳性率最高，可达80%～90%，第二周后逐步下降，第三周末50%左右，以后迅速降低，再燃或复发时可出现阳性，故对诊断伤寒最有意义的是血细菌培养阳性（B对）。稽留热可见于大叶性肺炎、斑疹伤寒及伤寒高热期，故稽留热非伤寒的特异性表现（A错）。伤寒可有脾大（C错）、肝大（D错）、相对缓脉（E错）的表现，但均不是伤寒的特异性表现，故不具有诊断性意义。